处理外伤性直肠损伤选择
A. 一期修补
B. 直肠切除后吻合
C. 乙状结肠造瘘，2～3月后处理
D. 观察2日
E. 生理盐水冲洗，待其自行吻合

正确答案：C。乙状结肠造瘘，2～3月后处理

解析：直肠内容物液体成分少而细菌含量多，因此直肠损伤后应妥善处理，以避免引起严重的并发症。直肠损伤的处理原则是早期彻底清创（D错），修补破损的直肠或切除后端端吻合，同时行乙状结肠造瘘、直肠周围间隙引流，以预防感染，2～3月后再闭合造口（C对B错）。部分腹膜反折线以上的直肠损伤患者，若全身和局部情况良好，破口可一期修补，不做近端造口（A错）。由于直肠部位细菌量多、污染较重，仅用生理盐水冲洗不能彻底清创，伤口不仅不能自行愈合，且易引发严重感染（E错）。